女，60岁，牙床肿痛2周，1年前曾有过肿痛，但未治疗。检查：左下6颊侧牙龈肿胀，有一瘘管，瘘管指向根尖方向，其颊侧中央及远中、舌侧均有5～6mm的牙周袋。为明确诊断，应作的一项重要检查是拍摄X线片，该患牙最可能的诊断是
A. 牙髓炎
B. 慢性牙周炎
C. 边缘性龈炎
D. 根分叉病变
E. 牙周-牙髓联合病变

正确答案：E。牙周-牙髓联合病变

解析：本题考查牙周-牙髓联合病变。根据病例描述，牙床肿痛2周，左下6颊侧牙龈肿胀，颊侧中央及远中、舌侧均有5～6mm的牙周袋，可考虑患者有牙周炎。瘘管指向根尖方向考虑患牙根尖有化脓性炎症，由于病例中并未描述左下6有龋坏或牙体缺损等牙髓感染途径，则可考虑根尖的炎症感染来自于牙周袋的逆行性感染，因此最可能的诊断为牙周-牙髓联合病变（E对），而不是单纯的牙髓炎（A错）和慢性牙周炎（B错）。边缘性龈炎（C错）是菌斑性牙龈病中的常见疾病，不会有5～6mm的牙周袋，故不考虑是边缘性龈炎。根分叉病变（D错）是指牙周炎的病变和破坏波及了多根牙的根分叉区，在该处出现牙周袋、附着丧失和牙槽骨吸收，病例中无相关诊断依据。